下肢骨不能触及的结构是
A. 髂嵴
B. 股骨内、外上髁
C. 胫骨粗隆
D. 小转子
E. 大转子

正确答案：D。小转子

解析：髂嵴（A对）、股骨内、外上髁（B错）、胫骨粗隆（C错）、大转子（E错）均可在体表扪及，是重要的骨性标志，小转子在体表不可扪及（D错，为本题正确答案）。